盐酸哌替啶含有
A. 吗啡喃结构
B. 苯吗喃结构
C. 哌啶结构
D. 氨基酮结构
E. 环己基胺结构

正确答案：C。哌啶结构

解析：本题考查镇痛药物结构特点。盐酸哌替啶属于4-苯基哌啶(C对)类结构的镇痛药，其结构可以看作仅保留吗啡A环和E环的类似物。含有吗啡喃结构（A错）的为吗啡喃类镇痛药。含有苯吗喃结构（B错）的镇痛药为苯并吗喃类镇痛药。含有氨基酮结构（D错）的为氨基酮类镇痛药，代表药物美沙酮。盐酸哌替啶不含环己胺结构（E错）。